男，22岁，学生，受凉后畏寒，高热3天，右胸痛及右上腹痛2天，深吸气时加剧，查体：39.5℃，P120次/分，R36次/分，BP80/50mmHg，巩膜轻度黄染，肺叩诊浊音，右下肺可闻及支气管呼吸音，心率120次/分，律不齐，偶有早搏，中上腹轻度压痛，肢端湿冷，此患者除抗感染治疗外，应首先采取的诊疗措施是
A. 液体复苏
B. 胸腹部CT检查
C. 机械通气治疗
D. 静脉注射碳酸氢钠
E. 急诊腹部B超检查

正确答案：A。液体复苏

解析：青壮年男性患者，有受凉史，高热，胸痛及上腹痛，深吸气时加剧，查体：39.5℃（正常值36℃～37℃），P120次/分（正常值60～100次/分），R36次/分（正常值16～20次/分），BP80/50mmHg（正常值90～120/60～80mmHg），巩膜轻度黄染，肺叩诊浊音，右下肺可闻及支气管呼吸音，心率120次/分（60～100次/分），律不齐，中上腹轻度压痛，肢端湿冷（休克表现），可诊断为肺炎链球菌性肺炎，该患者有休克，需首选液体复苏（A对）纠正休克。胸腹部CT检查（B错）适用于胸腹部实质性脏器的检查。机械通气治疗（C错）适用于呼吸衰竭和危重患者。静脉注射碳酸氢钠（D错）适用于酸碱平衡失调。急诊腹部B超检查（E错）适用于腹部脏器的检查，患者中上腹轻度压痛与炎症累及膈胸膜有关，无需急诊腹部B超检查。